磺胺药的药理作用是
A. 对病毒感染有效
B. 对念珠菌属的细菌感染有效
C. 杀灭结核分枝杆菌
D. 抑制二氢蝶酸合酶活性
E. 对立克次体感染有效

正确答案：D。抑制二氢蝶酸合酶活性

解析：磺胺药是抑菌药，它通过干扰细菌的叶酸代谢而抑制细菌的生长繁殖，与人和哺乳动物细胞不同，对磺胺药敏感的细菌不能直接利用周围环境中的叶酸，只能利用对氨苯甲酸（PABA）和二氢蝶啶，在细菌体内经二氢叶酸合成酶的催化合成二氢叶酸，再经二氢叶酸还原酶的作用形成四氢叶酸。磺胺药的结构和PABA相似，因而可与PABA竞争二氢叶酸合成酶从而抑制二氢蝶酸合酶活性（D对），阻碍二氢叶酸的合成，从而影响核酸的生成，抑制细菌生长繁殖。对病毒感染有效（A错）为阿昔洛韦等抗病毒药。对念珠菌属的细菌感染有效（B错）为酮康唑类药物。杀灭结核分枝杆菌（C错）为抗结核药物如利福平、异烟肼等。四环素类药物对立克次体感染有效（E错）。